白芍的归经是
A. 肝肾
B. 肝脾
C. 心肝
D. 心脾
E. 肺脾

正确答案：B。肝脾

解析：本题考查药物的归经。白芍归肝、脾经（B对），性味苦、酸，微寒。具有养血敛阴，柔肝止痛，平抑肝阳的功效。